临床上长期大量使用可的松治疗某些疾病时，可出现
A. 甲状腺组织高度增生
B. 肾上腺皮质逐渐萎缩
C. 肾上腺髓质高度增生
D. 性腺组织逐渐萎缩
E. ACTH和CRH分泌增多

正确答案：B。肾上腺皮质逐渐萎缩